下列方剂中，麻黄用量最大的是
A. 麻黄汤
B. 麻杏甘石汤
C. 葛根汤
D. 大青龙汤
E. 小青龙汤

正确答案：D。大青龙汤

解析：大青龙汤麻黄六两最多（D对）。麻黄汤麻黄三两（A错）。麻黄杏仁甘草石膏汤麻黄四两（B错）。葛根汤麻黄三两（C错）。小青龙汤麻黄三两（E错）。